包括球形、肾形、豆状、矛头状的是
A. 球菌
B. 杆菌
C. 真菌
D. 螺形菌
E. 放线菌

正确答案：A。球菌

解析：球菌：包括球形、肾形、豆状、矛头状等多种，直径0.8～1.2μm，呈双球状、链状、葡萄状等多种排列形式。掌握“细菌的大小、形态和基本结构”知识点。